阑尾动脉来自
A. 右结肠动脉
B. 左结肠动脉
C. 回结肠动脉
D. 中结肠动脉
E. 乙状结肠动脉

正确答案：C。回结肠动脉

解析：回结肠动脉（C对）分数支营养回肠末端、盲肠、阑尾和升结肠，其中分布至阑尾的分支称阑尾动脉。